使用使君子驱蛔，最大剂量不宜超过
A. 5粒
B. 10粒
C. 15粒
D. 20粒
E. 25粒

正确答案：D。20粒

解析：使君子的用量为一日总量不超过20粒（D对），所以使用使君子驱蛔，最大剂量不宜超过20粒，5粒不属于不宜超过的最大剂量（A错），10粒也不属于不宜超过的最大剂量（B错），15粒也不属于不宜超过的最大剂量（C错），25粒超过了最大适宜的剂量（E错）服用使君子时忌饮浓茶。